某男，56岁。患肾阳不足之泄泻5年，症见肠鸣腹胀、五更泄泻、食少不化，面黄肢冷。医师处以成药四神丸。其处方组成的臣药是
A. 附子（制）
B. 吴茱萸（制）
C. 肉豆蔻（煨）
D. 五味子（制）
E. 补骨脂（盐炒）

正确答案：C。肉豆蔻（煨）

解析：本题考查的是四神丸的方义简释。某男，56岁。患肾阳不足之泄泻5年，症见肠鸣腹胀、五更泄泻、食少不化，面黄肢冷。医师处以成药四神丸。其处方组成的臣药是肉豆蔻（煨）（C对）。四神丸：【方义简释】方中盐炒补骨脂（E错）苦辛温燥，温补涩纳，善补肾助阳，温脾止泻，恰中病的，故为君药。煨肉豆蔻温而涩敛，辛香燥散，善温脾暖胃，涩肠止泻，可助君药温脾止泻，故为臣药。制吴茱萸（B错）辛热香散，苦降而燥，有小毒，力较强，善温中散寒、助阳止泻；醋五味子（D错）酸敛质润温补，善固肾涩肠止泻。二药相合，助君臣药温肾散寒，温脾止泻，故为佐药。大枣甘温补缓，善补脾益胃、调和药性；生姜辛微温而发散，善温中散寒开胃。二者相合，既健脾开胃以增药力，又调和诸药，故为佐使药。全方配伍，温补固涩，共奏温肾散寒、涩肠止泻之功，故善治肾阳不足所致的泄泻，症见肠鸣腹胀、五更泄泻、食少不化、久泻不止、面黄肢冷。